有关咽鼓管错误的是
A. 咽鼓管咽口位于鼻咽部的侧壁
B. 咽鼓管鼓室口开口于鼓室的前壁
C. 咽鼓管分为骨部和软骨部
D. 成人咽鼓管比幼儿相对较大而平
E. 无

正确答案：D。成人咽鼓管比幼儿相对较大而平

解析：咽鼓管分为骨部和软骨部（C对）。咽鼓管鼓室口开口于鼓室的前壁（B对）。咽鼓管咽口位于鼻咽部的侧壁（A对）。幼儿咽鼓管较成人短而平，管径也较大（D错，为本题正确答案）。